位于手内侧，第5掌指关节尺侧近端赤白肉际凹陷中的腧穴是
A. 养老
B. 支沟
C. 后溪
D. 内关
E. 外关

正确答案：C。后溪

解析：该题主要考察腧穴定位。后溪定位在手内侧，第5掌指关节尺侧近端赤白肉际凹陷中（C对）。养老定位在前臂后区，腕背横纹上1寸，尺骨头桡侧凹陷中（A错）；支沟定位在前臂后区腕背侧远端横纹上3寸，尺骨与桡骨间隙中点（B错）；在前臂前区，腕掌侧远端横纹上2寸，掌长肌腱与桡侧腕屈肌腱之间（D错）；外关定位在前臂后区，腕背侧远端横纹上2寸，尺骨与桡骨间隙中点（E错）。